属于钙通道阻滞剂（第Ⅳ类）的抗心律失常药是
A. 维拉帕米
B. 胺碘酮
C. 美西律
D. 拉贝洛尔
E. 普鲁卡因胺

正确答案：A。维拉帕米

解析：本题考查维拉帕米。维拉帕米（A对）为钙通道阻滞剂，通过抑制钙离子内流，延长窦房结和房室结有效不应期和功能不应期。胺碘酮（B错）为延长动作电位时程药，属于广谱抗心律失常药。美西律（C错）为Ⅰb类抗心律失常药，临床用于室性心律失常。拉贝洛尔（D错）为β受体阻断剂。普鲁卡因胺（E错）为Ⅰa类钠通道阻滞剂，属于广谱抗心律失常药。